神识不清，语言重复，时断时续，声音低弱，属
A. 夺气
B. 郑声
C. 错语
D. 独语
E. 谵语

正确答案：B。郑声

解析：郑声表现为神识不清，语言重复，时断时续，语声低弱模糊（B对）。多因久病脏气衰竭，心神散乱所致，属虚证，故《伤寒论》谓“虚则郑声”。夺气表现为语言低微，气短不续，欲言不能复言，是宗气大虚之象（A错）。错语多表现为神识清楚而语言时有错乱，说后自知言错（C错）。独语表现为自言自语，喃喃不休，见人语止，首尾不续（D错）。谵语多表现为神识不清，语无伦次，声高有力，常由邪热内扰神明所致，属实证（E错）。